男，50岁。水肿2周，少尿伴血压升高1周。3周前曾有皮肤感染史。尿常规：尿蛋白（+），沉渣镜检RBC20～30/HP，血肌酐140μmol/L，尿素氮11mmol/L，补体C3降低，肾穿刺提示为毛细血管内增生性肾小球肾炎。通常该患者C3恢复正常的时间约为
A. 半年
B. 1年
C. 8周
D. 3个月
E. 2周

正确答案：C。8周

解析：老年男性，水肿2周，少尿伴血压升高1周。肾穿刺提示为毛细血管内增生性肾小球肾炎。毛细血管内增生性肾小球肾炎起病初期血清C3及总补体下降，8周内逐渐恢复正常（C对，ABDE错）。